关于狂犬病病毒的特点，哪项错误
A. 患病动物是传染源
B. 病毒只有一个血清型
C. 狂犬咬伤后100%发病
D. 可发生毒力变异
E. 可用病毒固定毒株制备疫苗进行预防

正确答案：C。狂犬咬伤后100%发病